延胡索的功效有
A. 活血
B. 消积
C. 行气
D. 凉血
E. 止痛

正确答案：A、C、E。活血；行气；止痛

解析：本题考查的是活延胡索的功效。延胡索的功效有活血（A对）、行气（C对）与止痛（E对）。延胡索：【功效】活血，行气，止痛。莪术：【功效】破血行气，消积（B错）止痛。郁金：【功效】活血止痛，行气解郁，凉血（D错）清心，利胆退黄。